疫苗接种的最佳时间是
A. 在流感流行高峰前2～3个月
B. 在流感流行前1～2个月
C. 在流感流行高峰前1～2个月
D. 在流感流行前2～3个月
E. 在流感流行高峰时

正确答案：C。在流感流行高峰前1～2个月

解析：本题考查疫苗接种的最佳时间。疫苗接种的最佳时间是在流感流行高峰前1～2个月（C对ABDE错），这样能更有效发挥疫苗的保护作用。